有关片剂的正确表述是
A. 咀嚼片是指含有碳酸氢钠和枸橼酸作为崩解剂的片剂
B. 多层片是指含有碳酸氢钠和枸橼酸作为崩解剂的片剂
C. 薄膜衣片是以丙烯酸树脂或蔗糖为主要包衣材料的片剂
D. 口含片是专用于舌下的片剂
E. 缓释片是指能够延长药物作用时间的片剂

正确答案：E。缓释片是指能够延长药物作用时间的片剂

解析：本题考查片剂。缓释片是在规定的释放介质中缓慢地非恒速释放药物（E对）；含有碳酸氢钠和枸橼酸作为崩解剂的片剂为泡腾片（AB错）；薄膜衣片是指高分子材料为主要包衣材料进行包衣制得的片剂，而蔗糖不是高分子材料（C错）；口含片是在口腔中缓慢溶解并发挥治疗作用的片剂，用于舌下的是舌下片（D错）。